反映胎儿肺成熟度的是
A. 卵磷脂/鞘磷脂比值
B. 淀粉酶值
C. 胆红素类物质
D. 含脂肪细胞出现率
E. 肌酐值

正确答案：A。卵磷脂/鞘磷脂比值

解析：胎儿肺成熟包括肺组织成熟与肺功能成熟，肺功能成熟即指肺泡表面活性物质的合成。卵磷脂和鞘磷脂是肺泡表面活性物质的主要成分，可维持肺的稳定性，因此通过检测卵磷脂和鞘磷脂的含量及其比值（A对）（该值＞2，提示胎儿肺成熟）可判断胎儿肺的成熟度。胆红素类物质（C错）可反映肝成熟度。肌酐值（实用妇产科学第2版P114）（E错）可反映肾成熟度。淀粉酶值（实用妇产科学第2版P115）（B错）可了解胎儿唾液腺是否成熟。含脂肪细胞出现率（实用妇产科学第2版P114）（D错）可作为胎儿皮脂腺成熟的指标。